治疗结节硬化型霍奇金淋巴瘤首选方案是
A. M2方案
B. ESHAP方案
C. ABVD方案
D. CHOP方案
E. VLDP方案

正确答案：C。ABVD方案

解析：结节硬化型霍奇金淋巴瘤首选化疗方案是ABVD（C对）方案。MOPP方案（A错）为ABVD方案出现之前霍奇金淋巴瘤首选化疗方案；ESHAP方案（P590）（B错）、CHOP方案（P590）（D错）为侵袭性非霍奇金淋巴瘤的化疗方案；VLDP方案（P575）（E错）为急性淋巴细胞白血病常用的诱导缓解方案。